肾小球有效滤过压等于
A. 肾小球毛细血管血压+血浆胶体渗透压-囊内压
B. 肾小球毛细血管血压-血浆晶体渗透压+囊内压
C. 肾小球毛细血管血压+血浆胶体渗透压+囊内压
D. 肾小球毛细血管血压-血浆晶体渗透压-囊内压
E. 肾小球毛细血管血压-血浆胶体渗透压-囊内压

正确答案：E。肾小球毛细血管血压-血浆胶体渗透压-囊内压

解析：肾小球有效滤过压=（肾小球毛细血管静水压+囊内液胶体渗透压）—（血浆胶体渗透压+肾小囊内压）。正常情况下，肾小球毛细血管静水压就等于肾小球毛细血管血压，囊内液胶体渗透压接近于0mmHg，肾小球有效滤过压等于肾小球毛细血管血压－血浆胶体渗透压－囊内压。